甲硝唑栓
A. 具有升华性
B. 具有融化性
C. 具有易挥发性
D. 具有易水解性
E. 具有易风化性

正确答案：B。具有融化性